医患关系的核心内容是
A. 医患关系具有明确的目的性
B. 医患关系是建立在医患平等基础上的帮助性的人际关系
C. 医患关系是以患者为中心的人际关系
D. 医患关系具有明显的时限性
E. 时限性与医患关系的职业性密切相关

正确答案：A。医患关系具有明确的目的性

解析：医患关系具有明确的目的性：医患关系是一种职业性人际关系。医患关系以医疗活动为中心，以维护患者健康为目的。这是医患关系的核心内容。掌握“医患关系概述及医患交往的形式和水平”知识点。